普萘洛尔与硝酸酯类合用治疗心绞痛的协同作用是
A. 降低心肌耗氧量
B. 保护缺血心肌细胞
C. 增加心室容积
D. 加强心肌收缩力
E. 松弛血管平滑肌

正确答案：A。降低心肌耗氧量

解析：普萘洛尔是β受体阻滞剂，当心脏交感神经张力增高时，对心脏的抑制作用明显，主要表现为心率减慢，心肌收缩力减弱（D错），心输出量减少，心肌耗氧量下降。硝酸甘油类可以松弛血管平滑肌（E错），可明显扩张动静脉血管，心室容积减小（C错），降低心脏前后负荷，从而降低心肌耗氧量，释放一氧化氮，促进内源性的PGI₂、降钙素基因相关肽等物质生成与释放，这些物质对心肌细胞均有直接保护作用（B错）。所以普萘洛尔与硝酸酯类合用治疗心绞痛的协同作用是减低心肌耗氧量（A对）。